第一恒磨牙有釉质发育不全，说明受累年龄在出生后
A. 五年内
B. 三年内
C. 二年后
D. 二年内
E. 一年内

正确答案：E。一年内

解析：本题考查牙釉质发育不全。釉质发育不全是指在牙发育期间，由于全身疾患、营养障碍或严重的乳牙根尖周感染导致釉质结构异常。致病因素发生在牙发育期才会导致釉质发育不全，所以可根据釉质发育不全的部位，可推断致病因素作用的时间。第一恒磨牙发育时间为1岁以内，第一恒磨牙有釉质发育不全，说明受累年龄在出生后一年内（E对）。受累年龄在出生后第二年内，会导致上颌侧切牙的釉质发育不全（D错）。受累年龄在出生后两到三岁以后，会导致前磨牙和第二磨牙釉质发育不全（ABC错）。